对于同一种化学物，在相同的条件下，下列哪项毒性指标数值最大
A. LD₅₀
B. LD₀
C. LD₀₁
D. LD₁₀₀

正确答案：D。LD₁₀₀

解析：本题考查数值最大的毒性指标。LD₁₀₀即绝对致死剂量，指引起一组受试实验动物全部死亡的最低剂量或浓度。对于同一种化学物，在相同的条件下，LD₁₀₀（D对ABC错）数值最大。